治疗剂量吗啡即可引起的不良反应是
A. 恶心、呕吐、便秘
B. 耐受性和依赖性
C. 血压升高
D. 呼吸肌麻痹
E. 呼吸急促

正确答案：A。恶心、呕吐、便秘